下列说法正确的是
A. 非传染性疾病己成为人口的首要死因
B. 慢性传染性疾病已成为人口的首要死因
C. 慢性非传染性疾病已成为人口的首要死因
D. 传染性疾病已成为人口的首要死因
E. 慢性非传染性疾病已成为人口的首要死因之一

正确答案：C。慢性非传染性疾病已成为人口的首要死因

解析：本题考查慢性非传染性疾病的相关内容。慢性非传染性疾病不是特指某种疾病，而是对一组起病时间长、缺乏明确的病因证据、一旦发病即病情迁延不愈的非传染性疾病的概括性总称。慢性非传染性疾病已成为人口的首要死因（C对ABDE错）。